下列关于CT临床应用优点的描述，错误的是
A. CT对癌症及微小病变的早期发现和诊断有重要意义
B. CT对头颅病变脊椎与脊髓及盆部器官的疾病诊断都有良好的运用价值
C. 双源CT下的冠脉造影，可以帮助判断冠状动脉有无狭窄及狭窄程度
D. CT检查具有无X线辐射无痛苦无骨性伪影的特点
E. CT对中枢神经系统疾病的诊断价值更高

正确答案：D。CT检查具有无X线辐射无痛苦无骨性伪影的特点

解析：CT检查具有X线辐射并且CT检查的辐射剂量通常高于单次X光摄影。MRI与CT相比，它没有放射辐射，没有骨性伪影（D错，为本题正确答案）。CT对癌症及微小病变的早期发现和诊断有重要意义。CT对头颅病变脊椎与脊髓及盆部器官的疾病诊断都有良好的运用价值（A对），CT对头颅病变脊椎与脊髓及盆部器官的疾病诊断都有良好的运用价值（B对），双源CT下的冠脉造影，可以帮助判断冠状动脉有无狭窄及狭窄程度（C对）。CT对中枢神经系统疾病的诊断价值更高（E对）。